下列哪项正确
A. 肾乳头与肾小盏的数目相同
B. 肾皮质由肾锥体和肾柱构成
C. 肾大盏与肾盂的数目相同
D. 肾大盏与肾乳头数目相同
E. 肾锥体底朝向皮质

正确答案：E。肾锥体底朝向皮质

解析：每个肾有7~12个肾乳头，7~8个肾小盏，2~3个肾小盏合成1个肾大盏，2~3个肾大盏汇合形成1个肾盂。所以数目关系是肾盂＞肾大盏＞肾小盏＞肾乳头（ACD错）。肾皮质由肾小体与肾小管组成（B错），肾髓质由底朝向肾窦的肾锥体（E对）构成。